为高血压患者制定膳食计划，不需要限制摄入量的是
A. 脂肪
B. 能量
C. 胆固醇
D. 钙
E. 食盐

正确答案：D。钙

解析：本题考查高血压患者的膳食计划。高血压患者膳食计划中，提倡多摄入富含钙（D对）的食品，如奶和奶制品。需要限制脂肪（A错）、能量（B错）、胆固醇（C错）和食盐（E错）的摄入量。